背阔肌受（）神经支配
A. 受颈丛的分支支配
B. 受臂丛的分支支配
C. 受肋间神经的分支支配
D. 受腰丛的分支支配
E. 受骶丛的分支支配

正确答案：B。受臂丛的分支支配

解析：背阔肌由臂丛发出的胸背神经支配（B对）。颈丛发出的分支主要支配头颈部的皮肤和肌（A错）。肋间神经发出分支支配肋间肌、腹肌以及胸部皮肤（C错）。由腰丛发出的分支支配腹股沟区、大腿前部和大腿内侧部（D错。由骶丛发出的分支支配下肢肌（E错）。